药品采购供应的道德要求的核心是
A. 严谨准确
B. 安全迅速
C. 确保药品质量
D. 不抬高价格
E. 合理用药

正确答案：C。确保药品质量